治疗钩端螺旋体感染，宜选用的药物是
A. 链霉素
B. 两性霉素
C. 红霉素
D. 青霉素
E. 氯霉素

正确答案：D。青霉素

解析：本题考查青霉素。青霉素（D对）为青霉素类抗菌药物，是治疗钩端螺旋体病、梅毒及回归热的首选药。链霉素（A错）与其它抗结核药联合用于结核分枝杆菌所致的各种结核病的初治病例或其它敏感分枝杆菌感染。两性霉素（B错）主要用于敏感真菌所致的深部感染如败血症、心内膜炎等。红霉素（C错）为大环内酯类抗菌药，抗菌效力不及青霉素，不用于治疗钩端螺旋体感染。氯霉素（E错）仅用于治疗威胁生命的感染如细菌性脑膜炎或立克次体感染。